描述居住建筑基底面积占居住建筑用地面积比例用
A. 居住建筑密度
B. 人口净密度
C. 人口毛密度
D. 居住系数
E. 建筑容积率

正确答案：A。居住建筑密度

解析：本题考查居住区环境质量评价指标。描述居住建筑基底面积占居住建筑用地面积比例用居住建筑密度（A对D错）。单位住宅用地上居住的人口数量，称为人口净密度（B错）。单位居住用地上居住的人口数量，称为人口毛密度（C错）。建筑容积率（E错）是指居住区总建筑面积与建筑用地面积的比值。